热闭、寒闭神昏，均常选用的药物是
A. 石菖蒲
B. 麝香
C. 牛黄
D. 羚羊角
E. 苏合香

正确答案：B。麝香

解析：该题考查麝香的应用。石菖蒲芳香走窜，不但有开窍醒神之功，而且能化湿，豁痰，辟秽，擅长治痰湿秽浊之邪蒙蔽清窍所致的神志昏乱，同时可治疗热闭神昏（A错）。麝香走窜之性甚烈，有很强的开窍通闭、辟秽化浊作用，可用于各种原因所致之闭证神昏，无论寒闭、热闭，用之皆效（B对）。牛黄性凉，其气芳香，入心经，能清心，祛痰，开窍醒神，用于热病神昏（C错）。羚羊角无开窍醒神之功效（D错）。苏合香辛香气烈，有开窍醒神之效，且长于温痛、辟秽，用于寒闭神昏（E错）。